郁李仁除润肠通便外，又能
A. 补气
B. 敛汗
C. 养心安神
D. 清热解毒
E. 利水消肿

正确答案：E。利水消肿

解析：本题考查郁李仁的功效。郁李仁除润肠通便外，又能利水消肿（E对）。郁李仁【功效】润肠通便，利水消肿。西洋参【功效】补气（A错）养阴，清热生津。酸枣仁【功效】养心安神（C错），敛汗（B错）。升麻【功效】发表透疹，清热解毒（D错），升举阳气。